根据社区卫生服务中心基本设施设置指导标准，至少要设有
A. 诊断室
B. 诊断、治疗室
C. 诊断、治疗、预防保健室
D. 诊断、治疗、预防保健室、健康教育宣传栏
E. 诊断、治疗、药房、健康教育宣传栏

正确答案：D。诊断、治疗、预防保健室、健康教育宣传栏